下列哪项不属于面神经
A. 鼓索
B. 岩大神经
C. 耳颞神经
D. 颧支
E. 颊支

正确答案：C。耳颞神经

解析：面神经的主要分支①面神经管段的分支：岩浅大神经主要含有副交感节前纤维，其节后纤维分布于泪腺、鼻和腭黏膜的腺体。镫骨神经支配镫骨肌。鼓索含有两种纤维：味觉纤维和副交感纤维。②颅外段的分支：面神经出茎乳孔后，在距皮肤表面2～3cm向前外，并稍向下经外耳道软骨和二腹肌后腹之间，在腮腺覆盖下，经茎突根部的浅面，进入腮腺，形成五组分支，由上至下依次为：颞支分布于额肌、眼轮匝肌上份、耳上肌和耳下肌。颧支分布于眼轮匝肌、额肌和上唇方肌。颊支位于腮腺导管上方的称为上颊支，位于导管下方的称为下颊支。分布于颧肌、笑肌、上唇方肌、尖牙肌、口轮匝肌和颊肌等。下颌缘支分布于三角肌、下唇方肌。颈支分布于颈阔肌，并有分支与颈皮神经交通。耳颞神经为三叉神经的分支下颌神经的分支。掌握“面神经、舌咽神经、舌下神经的分支与分布”知识点。